女，19岁，农民。12月在水利工地上突起发热，伴头痛，眼眶痛，腰痛。病程第四日就诊时热已退，血压偏低，球结膜水肿，出血，胸背部见条索点状瘀点。前一日24小时尿量340mL，该病例最可能的诊断是
A. 败血症
B. 血小板减少性紫癜
C. 流行性出血热
D. 钩端螺旋体病
E. 急性肾小球肾炎

正确答案：C。流行性出血热

解析：流行性出血热（C对）又称肾综合征出血热，以发热、出血、充血、低血压休克及肾脏损害为主要临床表现。典型临床经过分为五期：发热期、低血压休克期、少尿期、多尿期及恢复期。发热期出现头痛、腰痛、眼眶痛、球结膜水肿；热退后进入低血压休克期，轻者血压出现降低，重者出现休克；随后进入少尿期，24小时尿量少于400mL。本例患者有明确户外接触史（水利工地），临床表现符合流行性出血热。血小板减少性紫癜（B错）血小板计数减少，而血细胞形态无异常，临床表现为口腔黏膜出血等。钩体病（D错）的临床特点为起病急骤，早期有高热，全身酸痛、软弱无力、结膜充血、腓肠肌压痛、表浅淋巴结肿大等钩体毒血症状；中期可伴有肺出血，肺弥漫性出血、心肌炎、溶血性贫血、黄疸，全身出血倾向、肾炎、脑膜炎，呼吸功能衰竭、心力衰竭等靶器官损害表现；晚期多数病例恢复，少数病例可出现后发热、眼葡萄膜炎以及脑动脉闭塞性炎症等多种与感染后的变态反应有关的后发症。因此本病例容易误选钩体病，但是出血热不会出现腓肠肌压痛症状。急性肾小球肾炎（E错）出现典型肾炎综合征，即血尿、蛋白尿、水肿、高血压。败血症表现一般为急性起病、寒战、高热、呼吸急促、心动过速，以及皮疹、关节肿痛、肝脾肿大和精神、神志改变等（A错）。